男，65岁。排便次数增加6个月，伴里急后重、排便不尽感。1个月来大便变细，偶有大便表面带血，自觉乏力，体重减轻4Kg。决定该病人手术方式的要点是
A. 是否合并肠周淋巴结转移
B. 病灶浸润肠壁的深度
C. 病灶下缘距齿状线距离
D. 病灶浸润肠壁的周长
E. 病灶浸润肠壁的长度

正确答案：C。病灶下缘距齿状线距离

解析：老年男性患者，排便次数增加6个月，伴里急后重、排便不尽感（直肠刺激症状）。1个月来大便变细，偶有大便表面带血，自觉乏力，体重减轻4Kg。综合患者的症状、体征，初步诊断为直肠癌。决定该病人手术方式的要点是病灶下缘距齿状线距离（C对）。若病灶下缘距齿状线为5cm以上，则选用Dixon术。是否合并肠周淋巴结转移（A错）、病灶浸润肠壁的深度（B错）、病灶浸润肠壁的周长（D错）、病灶浸润肠壁的长度（E错）均不是决定该病人手术方式的要点。